某患者，患乙型肝炎多年，近日病情加重，形成暴发性肝炎，试问该患者可能是合并哪种病毒的重叠感染
A. HAV
B. HCV
C. HDV
D. HEV
E. CMV

正确答案：C。HDV